可能与上皮珠相混淆的是
A. 新生牙
B. 多生牙
C. 弯曲牙根
D. 先天性缺牙
E. 融合牙

正确答案：A。新生牙

解析：本题考查牙齿萌出过早。可能与上皮珠相混淆的是新生牙（A对）。新生牙是指出生后30天内萌出的牙齿，应与上皮珠进行鉴别。多生牙（B错）：也称额外牙，是人类正常牙列以外发生的牙齿，可位于颌骨的任何部位，可萌出于口腔内，也可埋伏于颌骨内。弯曲牙（C错）：是牙冠和牙根形成一定弯曲角度的牙齿，多指的是前牙弯曲。先天性缺牙（D错）：是在牙胚形成过程中或牙胚发育早期出现异常，牙胚未能发育或未形成牙齿而造成的缺牙。第三磨牙是最为常见的牙齿先天缺失。融合牙（E错）：是由两个正常牙胚的牙釉质或牙本质融合在一起而成，极少数情况可出现两个以上牙胚融合。